除另有规定外，中药散剂水分不得过
A. 0.12
B. 0.15
C. 0.03
D. 0.08
E. 0.09

正确答案：E。0.09

解析：本题考查的是中药散剂的水分要求。除另有规定外，中药散剂水分不得过9.0%（E对）。中药散剂照《中国药典》水分测定法测定，除另有规定外，不得过9.0%。水分不得过12.00%（A错）为中药水蜜丸和浓缩水蜜丸的水分要求，水分不得过15.00%（B错）为中药蜜丸和浓缩蜜丸的水分要求。除另有规定外，蜜丸和浓缩蜜丸中所含水分不得过15.0%；水蜜丸和浓缩水蜜丸不得过12.0%；水丸、糊丸、浓缩水丸不得过9.0%。蜡丸不检查水分。水分不得过3.00%（C错）为中药含糖块茶剂的水分要求。按照《中国药典》规定的方法检查，不含糖块状茶剂以及袋装茶剂与煎煮茶剂的水分不得过12.0%，含糖块状茶剂的水分不得过3.0%。水分不得过8.00%（D错）为中药颗粒剂的水分要求。除另有规定外，中药颗粒剂含水分不得过8.0%。